患者，男，65岁，患有冠心病、哮喘、开角型青光眼，因右下肢软组织感染入院。住院期间出现心悸、多汗等不适症状，新诊断为焦虑障碍，给予艾司西酞普兰治疗。不应同时使用的药物是
A. 沙美特罗替卡松
B. 阿司匹林
C. 利奈唑胺
D. 色甘酸钠
E. 普伐他汀

正确答案：C。利奈唑胺

解析：本题考查抗抑郁药物的禁忌证。选择性5-羟色胺再摄取抑制剂（SSRIs）（如氟西汀、帕罗西汀、舍曲林、艾司西酞普兰等）禁与替扎尼定、利奈唑胺（C错，为本题正确答案）、阿洛司琼、匹莫齐特和MAIOs合用。